颞下颌关节急性前脱位在手法复位以后，复位固定下颌的时间段是
A. 1～2周
B. 2～3周
C. 3～4周
D. 4～5周
E. 6天

正确答案：B。2～3周

解析：颞下颌关节急性脱位的治疗原则：应及时复位，复位后应限制下颌运动。必须在复位后固定下颌2～3周，限制开颌运动；开口度不宜超过1cm。掌握“颞下颌关节脱位”知识点。